莨菪碱具有
A. 水溶性
B. 很强的毒性
C. 明显的治疗艾滋病作用
D. 解痉镇痛作用
E. 镇咳作用

正确答案：D。解痉镇痛作用

解析：本题考查的是洋金花中生物碱的药理作用。莨菪碱具有解痉镇痛作用（D对）。莨菪碱及其外消旋体阿托品有解痉镇痛、解有机磷中毒和散瞳作用；东莨菪碱除具有莨菪碱的生理活性外，还有镇静、麻醉作用。具有水溶性（A错）的为亲水性生物碱。主要有氧化苦参碱、麻黄碱、烟碱、秋水仙碱、咖啡碱等。具有很强的毒性（B错）的是乌头碱。乌头碱类化合物有剧毒，用之不当易致中毒，且毒性较强，0.2mg即可中毒，2～4mg即可致人死亡。具有镇咳作用（E错）的是麻黄碱。麻黄水煎液、麻黄醇提取物、麻黄生物碱、麻黄碱均具有平喘、镇咳作用。具有明显的治疗艾滋病作用（C错）的生物碱，2022年考试指南未明确说明。